关于生物利用度定义的描述，正确的是
A. 药物进入体内的速度
B. 进入体内药物量与排泄量之比
C. 药物进入体循环的量与所给剂量的比值
D. 衡量不同剂型间差异的指标
E. 指非胃肠道给药的吸收程度

正确答案：C。药物进入体循环的量与所给剂量的比值

解析：本题考查生物利用度。生物利用度是指药物被吸收进入血液循环的程度和速度（C对AB错），是衡量不同制剂剂型疗效的重要指标（D错）；不只局限于非胃肠道给药（E错）。